属腹膜内位器官的是
A. 食管
B. 肾上腺
C. 十二指肠水平部
D. 乙状结肠
E. 降结肠

正确答案：D。乙状结肠

解析：食管(A错)不属于脏器，不在划分之列，肾上腺(B错)和十二指肠水平部(C错)为腹膜外位器官，乙状结肠(D对)为腹膜内位器官，降结肠(E错)为腹膜间位器官。